不引起呼吸道感染的一组病毒是
A. 麻疹病毒、EB病毒
B. 风疹病毒、ECHO病毒
C. 流行性乙型脑炎病毒、轮状病毒
D. 冠状病毒、腮腺炎病毒
E. 腮腺炎病毒、呼肠病毒

正确答案：C。流行性乙型脑炎病毒、轮状病毒